膜剂的成膜材料
A. 聚山梨酯
B. PVA聚乙烯醇
C. 甘露醇
D. 羟丙基甲基纤维素
E. 淀粉浆

正确答案：B。PVA聚乙烯醇

解析：本题考查膜剂的成膜材料。膜剂的成膜材料是PVA聚乙烯醇（B对）。膜剂成膜材料：常用的成膜材料有聚乙烯醇、丙烯酸树脂类、纤维素类及其他天然高分子材料。有天然（淀粉、纤维素、明胶、白及胶等）及合成（纤维素衍生物、聚乙烯醇等）两大类。最常用的是聚乙烯醇（PVA），其性质主要由聚合度和醇解度来决定。聚合度越大，水溶性越差。聚氧乙烯脱水山梨醇脂肪酸酯：又称为聚山梨酯（A错），本类表面活性剂是在司盘类表面活性剂分子结构的剩余羟基上，结合聚氧乙烯基而成的醚类化合物，商品为吐温类。由于分子中含有大量亲水性的聚氧乙烯基，故其亲水性显著增强，成为水溶性表面活性剂，主要用作增溶剂、O/W型乳化剂、润湿剂和助分散剂。甘露醇（C错）：为白色结晶性粉末，清凉味甜，易溶于水；无引湿性，可压性好，是口含片的主要稀释剂和矫味剂，亦可作为咀嚼片的填充剂和黏合剂。羟丙基甲基纤维素（D错）（HPMC）：是广泛应用的薄膜包衣材料。本品能溶解于任何pH值的胃肠液内，以及70%以下的乙醇、丙酮、异丙醇或异丙醇和二氯甲烷的混合溶剂（1:1）中，不溶于热水及60%以上的糖浆；具有极优良的成膜性能，膜透明坚韧，包衣时无黏结现象。淀粉浆（E错）（糊）：为最常用的黏合剂。系由淀粉加水在70℃左右糊化制成的稠厚胶体，放冷后呈胶胨状。一般浓度为8%～15%，以10%最为常用，实际使用浓度应根据原料、辅料的性质及颗粒的松紧要求而定。本品适用于对湿热稳定，而且药物本身不太松散的品种，尤适用于可溶性药物较多的处方。